心理评估中最常用的一种基本方法
A. 会谈法
B. 观察法
C. 作品分析法
D. 心理测验法
E. 调查法

正确答案：A。会谈法

解析：会谈法也称作“交谈法”、“晤谈法”等。其基本形式是主试者与被评估者面对面的语言交流，也是心理评估中最常用的一种基本方法。掌握“心理评估概述”知识点。